不符合溶血性黄疸临床特点的是
A. 血清总胆红素增高
B. 尿胆红素阳性
C. 血清间接胆红素升高
D. 尿血红蛋白阳性
E. 网织红细胞升高

正确答案：B。尿胆红素阳性

解析：溶血性黄疸是由于大量红细胞破坏，形成大量的非结合胆红素，超过肝细胞的摄取、结合与排泌的能力，血清间接胆红素（非结合胆红素）升高（C对），血清总胆红素增高（A对），出现黄疸。大量红细胞破坏，血中血红蛋白潴留，尿血红蛋白阳性（D对）。红细胞破坏过多，红系代偿性增生，网织红细胞升高（E对）。正常情况下，尿液中不含有胆红素。溶血性黄疸时，非结合胆红素升高，但其为脂溶性，不能透过肾小球屏障，所以尿胆红素并无明显升高（B错，为本题正确答案）。梗阻性黄疸和肝细胞性黄疸时，胆道阻塞，排除受阻，胆汁反流入血，血液中结合性胆红素升高，其为水溶性，出现尿胆红素强阳性和阳性。